反映肝硬化肝功能减退的指标是
A. 碱性磷酸酶
B. 谷氨酸氨基转移酶
C. 甲胎蛋白
D. 白蛋白
E. 丙氨酸氨基转移酶

正确答案：D。白蛋白

解析：肝硬化肝功能减退表现为消化吸收不良、黄疸、出血和贫血、内分泌失调（性激素代谢、肾上腺皮质功能、抗利尿激素、甲状腺激素、不规则低热、低清蛋白血症）。因此反映肝硬化肝功能减退的指标是白蛋白（D对）。